DNA突变分类包括
A. 错配
B. 缺失
C. 插入
D. 重排
E. 以上均包括

正确答案：E。以上均包括

解析：DNA突变可分为错配、缺失、插入和重排等几种类型。掌握“概述及DNA的生物合成”知识点。